关于腹痛的叙述，哪项是错误的
A. 空腔脏器的痉挛或扩张可引起腹痛
B. 腹膜的化学刺激可引起腹痛
C. 腹腔内血管阻塞可引起缺血性腹痛
D. 腹痛均因腹腔内脏病变所致
E. 腹痛原因未明确之前不宜用镇痛药

正确答案：D。腹痛均因腹腔内脏病变所致